口服避孕药的禁忌症不包括
A. 激素依赖性肿瘤
B. 不明原因阴道出血
C. 重度肝功能不全
D. 甲状腺功能减退
E. 有血栓或血栓病史

正确答案：D。甲状腺功能减退

解析：本题考查口服避孕药的禁忌症。甲状腺功能减退（D错，为本题正确答案）不属于口服避孕药的禁忌症。口服避孕药的禁忌症有：（1）哺乳期妇女。（2）重度肝功能不全（C对）、肾炎、心脏病、高血压、糖尿病、甲状腺功能亢进、子宫肌瘤、肺结核等病的妇女。（3）妊娠、不明原因阴道出血（B对）、肝脏疾病、血栓或血栓史（E对）和激素依赖性肿瘤（A对）等。（4）择期手术或需要长期卧床者，需要在手术（大手术或需静养不动）的前一个月就停止服用口服避孕药。